关于中枢性镇咳药的说法，错误的是
A. 选择性抑制延髓的咳嗽中枢，抑制支气管腺体的分泌
B. 可使痰液黏稠，黏痰难以咳出
C. 特别适用于无痰、干咳患者
D. 服药期间不得驾驶车、船，从事高空作业
E. 通常不具有较强的镇痛作用

正确答案：E。通常不具有较强的镇痛作用

解析：本题考查中枢性镇咳药。除了镇咳作用外，中枢性镇咳药通常还具有较强的镇痛、镇静作用（E错，为本题正确答案），可用于中度以上疼痛、局麻或全麻时镇静。